治疗小儿哮喘发作期寒证，应首选
A. 定喘汤
B. 麻杏石甘汤
C. 小青龙汤合三子养亲汤
D. 玉屏风散
E. 桑菊饮

正确答案：C。小青龙汤合三子养亲汤

解析：支气管哮喘寒性哮喘是由外感风寒而诱发，外寒里饮所致，治以温肺散寒，化痰定喘，方药为小青龙汤合三子养亲汤（C对）。定喘汤（A错）其功用为宣肺降气，清热化痰，适用于热性哮喘。麻杏石甘汤（B错）其功用辛凉疏表，清肺平喘，适用于热性哮喘。玉屏风散（D错）其功用为益气固表止汗，适用于表虚自汗证。桑菊饮（E错）其功用为疏风清热，宣肺止咳，适用于风温初起，表热轻证。